水体污染物的转归是指
A. 物理性状变化
B. 化学性质变化
C. 化学性质和毒作用变化
D. 光化学转化和生物转化
E. 污染物的空间位移及其形态变化

正确答案：E。污染物的空间位移及其形态变化

解析：本题考查水体污染物的转归。水体污染物的转归是指污染物在水环境中的空间位移和形态改变（E对ABCD错）。前者表现为量的变化，后者则是质的变化。 这两种变化之间通常存在相互联系。